患儿，11岁。幼时患有哮喘，每年春、冬复发。此次症见：咳嗽、气喘，喉部哮鸣，痰声辘辘。纳差，乏力，大便不整，小便清，神乏，面白光唇淡，舌苔薄白，舌质淡，脉沉无力。其治法是
A. 温肺散寒，化痰定喘
B. 清肺涤痰，止咳平喘
C. 健脾益气，涤痰平喘
D. 泻肺补肾，标本兼顾
E. 健脾温肾，化痰平喘

正确答案：C。健脾益气，涤痰平喘

解析：该题主要考查小儿哮喘的辩证以及治法。肺脾气虚为哮喘的缓解期，本证的基本病机是肺气虚而卫表不固，脾气虚而运化失健。临证以肺脾两脏气虚诸症为辨证要点。该患儿，11岁。幼时患有哮喘，每年春、冬复发。此次症见：咳嗽、气喘，喉部哮鸣，痰声辘辘。纳差，乏力，大便不整，小便清，神乏，面白光唇淡，舌苔薄白，舌质淡，脉沉无力。可判断为哮喘肺脾气虚，治法健脾益气，补肺固表，涤痰平喘（C对）。温肺散寒，化痰定喘为寒性哮喘治法，证候舌淡红，咳嗽气喘，喉间哮鸣，痰多白沫，形寒肢冷，鼻流清涕，面色淡白，恶寒无汗，苔白滑，脉浮滑（A错）。清肺涤痰，止咳平喘为热性哮喘治法，证候咳嗽喘息，声高息涌，喉间哮吼痰鸣，咳痰稠黄，胸隔满闷，身热面赤，口干咽红，尿黄便秘，舌红苔黄，脉滑数（B错）。泻肺补肾，标本兼顾为肺实肾虚哮喘治法，证候病程较长，哮喘持续不已，喘促胸满，动则喘甚，面色欠华，畏寒肢冷，神疲纳呆，小便清长，常伴咳嗽痰多，喉中痰吼，舌淡苔薄腻，脉细弱（D错）。健脾温肾，化痰平喘为脾肾阳虚治法， 证候动则喘促咳嗽，气短心悸，面色苍白，形寒肢冷，脚软无力，腹胀纳差，大便溏舌质淡，苔薄白，脉细弱（E错）。